长期应用氯丙嗪的病人停药后可出现
A. 帕金森综合征
B. 静坐不能
C. 迟发性运动障碍
D. 急性肌张力障碍
E. 直立性低血压

正确答案：C。迟发性运动障碍